防止疟疾复发选用的药物是
A. 乙胺嘧啶
B. 氯喹
C. 奎宁
D. 哌喹
E. 伯氨喹

正确答案：E。伯氨喹

解析：伯氨喹能杀灭肝脏中休眠子，控制疟疾的复发（E对），并能杀灭各种疟原虫的配子体，控制疟疾传播。乙胺嘧啶（A错）能杀灭红细胞外期的子孢子，发挥病因性预防作用。氯喹、奎宁均能杀灭红细胞内期裂殖体，主要用于控制症状发作和预防性抑制疟疾症状发作（BC错）。